医疗红色垃圾袋装
A. 棉花
B. 针头
C. 放射性废物
D. 一次性器械盒包装袋
E. 生活垃圾

正确答案：C。放射性废物

解析：本题考查医疗废物处理。医疗红色垃圾袋装放射性废物（C对）。口腔诊疗过程中产生的医疗废物应按照《医疗废物管理条例》《医疗卫生机构医疗废物管理办法》及有关法规、规章的规定进行处理。医疗废物的处理原则是防止污染扩散；主要方法是分类收集，集中并分别进行无害化处理。在临床医疗中设置三种颜色的废物袋，黑色袋装生活废物，黄色袋装除了尖锐性物品外的医疗废物，红色袋装放射性废物。尖锐性的损伤性废物应放于专门的利器容器内，安全运送到指定地点做无害化处理。棉花（A错）放于医疗黄色垃圾袋内；针头（B错）应放于专门的利器容器内；一次性器械盒包装袋（D错）和生活垃圾（E错）放于医疗黑色垃圾袋内。